相对于一般契约关系而言，医生在医患关系负有更重的义务，但这些义务中不包括
A. 监督义务
B. 保密义务
C. 披露义务
D. 注意义务
E. 忠实义务

正确答案：A。监督义务

解析：医患关系是一种具有契约性质的信托关系。从法律上说，医患关系是一种医疗契约关系。但这种契约关系与一般的契约关系不完全相同，这种契约没有订立一般契约的相关程序和条款，承诺内容未必与要约内容完全一致，医方负有更重的义务，如注意义务（D对）、忠实义务（E对）、披露义务（C对）、保密义务（B对），以及急危重症时强制的缔约义务等，对患者一方没有严格的约束力等，如监督义务（A错，为本题正确答案）。